劳动过程中的有害因素为
A. 通风换气不足
B. 作息制度不合理
C. 有害作业与无害作业在同一个车间内
D. 个人防护用品使用不当
E. 卫生设施不健全

正确答案：B。作息制度不合理